患者。男性。60岁。糖尿病合并皮肤感染。长期服用四环素，近来咽部出现白色薄膜，消化不良，腹泻，疑白色念珠菌病。宜用
A. 灰黄霉素
B. 制霉菌素
C. 两性霉素B
D. 阿昔洛韦
E. 利巴韦林

正确答案：B。制霉菌素